男婴，6个月，平时多汗，夜间惊醒哭闹，足月顺产，人工喂养，T36.6℃，P128/分，枕秃明显，无颅骨软化，前囟2厘米，双肺呼吸音清，心率128，齐，有力，各瓣膜正常，腹软，肝肋下1厘米，早期检查的结果是什么
A. 磷下降
B. 碱性磷酸酶升高
C. 钙下降
D. 长骨X线异常
E. 25-（OH）D3下降

正确答案：E。25-（OH）D3下降

解析：6个月，平时多汗，夜间惊醒哭闹，足月顺产，人工喂养，T36.6℃，P128/分，枕秃明显，无颅骨软化，前囟2厘米（符合25-（OH）D3下降），营养性维生素缺乏是引起佝偻病最主要的原因，是由于儿童体内维生素D不足导致钙和磷代谢紊乱（E对）。